蛋白质变性的结果是
A. 溶解度增加
B. 化学性质不变
C. 生物活性丧失
D. 氨基酸序列重构
E. 肽键断裂

正确答案：C。生物活性丧失

解析：本题考查蛋白质变性。蛋白质变性的结果是生物活性丧失（C对）。蛋白质的二级结构以氢键维系局部主链构象稳定，三、四级结构主要依赖于氨基酸残基侧链之间的相互作用，从而保持蛋白质的天然构象。但在某些物理和化学因素作用下，其特定的空间构象被破坏，也即有序的空间结构变成无序的空间结构，从而导致其理化性质的改变和生物学活性的丧失，称为蛋白质变性。一般认为蛋白质的变性主要发生二硫键和非共价键的破坏（E错），不涉及一级结构中氨基酸序列的改变（D错）。蛋白质变性后，其理化性质及生物学性质发生改变（B错），如溶解度降低（A错）、黏度增加、结晶能力消失、生物学活性丧失、易被蛋白酶水解等。造成蛋白质变性的因素有多种，常见的有加热、乙醇等有机溶剂强酸、强碱、重金属离子及生物碱试剂等。